肾是泌尿系统功能的主要执行者。位于腹膜后，其周围有被膜保护，具有产生尿液及重要的内分泌功能。肾
A. 表面覆有两层被膜
B. 左肾较右肾低
C. 第12肋斜过左肾后面中部
D. 成人肾门约平第3腰椎体
E. 以上说法都不正确

正确答案：C。第12肋斜过左肾后面中部

解析：肾的被膜分为三层（A错）：纤维囊、脂肪囊与肾筋膜。因受肝的挤压，右肾低于左肾（B错）。第12肋斜过左肾后面中部（C对），肾门约在第1腰椎椎体平面（D错）。